某制酒厂以木薯为原料生产蒸馏酒，某日因机械故障使生产过程排气受限，该日生产的酒最有可能出现的卫生问题是
A. 甲醇含量过高
B. 异戊醇含量过高
C. 杂醇油含量过高
D. 氢氰酸含量过高
E. N-二甲基亚硝胺含量过高

正确答案：D。氢氰酸含量过高